合理膳食包括
A. 能量和营养素满足需要
B. 食物多样化
C. 营养素之间要保持适宜的平衡
D. 应有舒适的进餐环境
E. 以上都包括

正确答案：E。以上都包括